以下对肾的描述中，正确的为
A. 肾皮质表面均覆盖有腹膜
B. 肾大盏包绕肾乳头
C. 肾柱属肾髓质的结构
D. 肾被膜的最外层为肾筋膜
E. 肾盂的尿液流入肾大盏

正确答案：D。肾被膜的最外层为肾筋膜

解析：肾的被膜由内向外依次为纤维囊、脂肪囊与肾筋膜（D对）。肾皮质主要位于肾实质的浅层，所以肾皮质表面覆盖纤维囊（A错）。肾柱为伸入肾锥体之间的肾皮质（C错）。包绕肾乳头的是肾小盏（B错），肾小盏的尿液流入肾大盏，肾大盏的尿液流入肾盂（E错）。